地图舌患者一般无明显的自觉症状，但有时可能出现症状是
A. 口干
B. 自发痛
C. 冷热痛
D. 阵发性疼痛
E. 烧灼感、刺激性痛

正确答案：E。烧灼感、刺激性痛

解析：地图舌患者一般无明显的自觉症状，但合并真菌、细菌感染或伴沟纹舌继发感染时，再食用刺激性食物、乙醇饮料等，则有时有烧灼感或刺激性痛。掌握“地图舌、沟纹舌及舌乳头炎”知识点。